依地酸钙钠用于解救
A. 砷盐中毒
B. 有机磷中毒
C. 铅盐中毒
D. 一氧化碳中毒
E. 氰化物中毒

正确答案：C。铅盐中毒

解析：本题考查中毒解救。依地酸钙钠用于解救铅盐中毒（C对）。砷盐中毒（A错）可用二巯丙醇解救。有机磷中毒（B错）的解毒剂为阿托品、碘解磷定、氯解磷定。一氧化碳中毒（D错）可用谷胱甘肽进行解毒，应尽快使患者脱离中毒环境，并供氧。氰化物中毒解救剂（E错）为亚甲蓝和硫代硫酸钠、亚硝酸钠等。